主要为找出影响分布的决定因素
A. 描述流行病学
B. 理论流行病学
C. 实验流行病学
D. 分析流行病学
E. 病例对照研究

正确答案：D。分析流行病学

解析：分析流行病学：主要是找出影响分布的决定因素。掌握“流行病学概论”知识点。